关于病因研究的方法，下列叙述哪项不恰当
A. 病因研究的方法有实验医学、临床医学和流行病学
B. 流行病学主要从群体水平探讨病因
C. 临床医学主要从个体水平探讨病因
D. 流行病学可为临床及实验研究提供病因线索
E. 临床医学验证病因最可靠

正确答案：E。临床医学验证病因最可靠

解析：本题考查病因研究的方法。病因研究的方法有实验医学、临床医学和流行病学（A对），流行病学主要从群体水平探讨病因（B对），临床医学主要从个体水平探讨病因（C对）。流行病学可为临床及实验研究提供病因线索（D对）。验证病因最可靠的方法是流行病学中希尔的病因推断准则（E错，为本题正确答案）。